蛇串疮的特征是
A. 皮疹呈多形性
B. 红色丘疹，散在分布
C. 粟粒状丘疹，散在分布
D. 簇集性水疱呈带状分布
E. 粟粒状丘疹呈带状分布

正确答案：D。簇集性水疱呈带状分布

解析：蛇串疮的皮损为多个成群的水疱，多沿神经走向排列成带状（D对），一般不超过正中线，疱群间有正常皮肤间隔，自觉疼痛明显，愈后多不再发。